上颌窦癌的临床特点中哪项可除外
A. 肿瘤发生在不同部位可出现不同症状，如鼻塞、复视、牙齿松动、张口受限等
B. 早期无症状，不易发现
C. 以鳞癌为常见
D. 早期即有明显骨质破坏
E. 远处转移较少见

正确答案：D。早期即有明显骨质破坏

解析：本题考查上颌窦癌的临床特点。上颌窦癌的临床特点中除外的是早期即有明显骨质破坏（D错，为本题的正确答案）。上颌窦癌为鼻旁鳞癌中的最常见者。以鳞状细胞癌为最常见（C对），偶为腺源性上皮癌。因为位于上颌窦内，早期无症状，不容易发觉（B对）；当肿瘤发展到一定的程度，出现较明显的症状时才被注意。根据上颌窦癌发生的部位，临床上可出现不同症状：当发生上颌窦内壁时，常先出现鼻阻塞、鼻出血、一侧鼻腔分泌物增多，鼻泪管流泪现象；发生在上壁时，常先使眼球突出、向上移位、可能引起复视；肿瘤发生在外壁时，则表现为面颊部肿胀、肿瘤外露、面颊部感觉迟钝或麻木；发生在后壁时，可引起张口困难；当发生在下壁时，则引起牙松动、疼痛、龈颊沟肿胀等（A对）。上颌窦癌常转移至下颌下及颈上部淋巴结，有时可转移至耳前及咽后淋巴结，远处转移少见（E对）。